女，30岁。体检时发现，HBsAg，抗HBc，抗HBe阳性。判断是否有传染性还应作的检查是
A. 肝功能
B. HBV DNA
C. HBeAg（e抗原）
D. 肝脏B超
E. 肝脏MRI

正确答案：B。HBV DNA

解析：HBsAg本身只有抗原性，无传染性。抗HBs是一种保护性抗体，抗HBs阳性表示对HBV有免疫力，见于乙型肝炎恢复期、过去感染及乙肝疫苗接种后。HBeAg一般仅见于HBsAg阳性血清。如果HBeAg持续存在预示趋向慢性。抗HBe阳转后，病毒复制多处于静止状态，传染性降低（C错）。血液中HBcAg主要存在于Dane颗粒的核心，游离的HBcAg极少。很难检出。血清中的抗HBc出现于HBsAg出现后3～5周，HBV感染者几乎均可检出抗HBc。HBV DNA（B对）是病毒复制和传染性的直接标志。定量检测HBVDNA对于判断病毒复制程度，传染性大小，抗病毒药物疗效等有重要意义。肝功能（A错）一般用于检测肝细胞损伤情况。肝脏B型超声、肝脏MRI（DE错）与患者的传染病的传染性相关性不大，B型超声有助于鉴别阻塞性黄疸、脂肪肝及肝内占位性病变。对肝硬化有较高的诊断价值。